男性，34岁，突然寒战高热，咳嗽，两周后咳大量脓臭痰。查体：右肺背侧肩胛下部可闻湿性啰音，WBC21×10⁹/L，中性粒细胞0.88。该病人要立即采取的治疗措施最重要的是
A. 解热镇痛剂
B. 祛痰止咳药
C. 青霉素静脉滴注
D. 卡那霉素
E. 甲硝唑

正确答案：C。青霉素静脉滴注

解析：青年患者高热、咳嗽咳痰两周后咳大量脓臭痰，感染中毒症状重，且右肺背侧肩胛下部可闻湿性啰音，考虑为肺脓肿。肺脓肿的治疗原则为抗炎和引流。吸入性肺脓肿多合并厌氧菌感染，青霉素对绝大多数厌氧菌都敏感，疗效较佳，故最常用（C对）。